关于儿童溺水的描述，下列错误的是
A. 溺水是一种常见的儿童意外伤害
B. 可因口鼻吸入大量水分阻塞呼吸道而引起窒息反应
C. 可因惊慌、骤然寒冷引起反射性喉头痉挛而导致窒息
D. 急救处理时，应将患儿头部抬起，迅速清除口鼻污物
E. 口对口人工呼吸时，应配合进行胸外心脏按压

正确答案：D。急救处理时，应将患儿头部抬起，迅速清除口鼻污物

解析：本题考查儿童溺水的预防及急救处理。儿童溺水急救处理时，不应该将患儿头部抬起，这样不利于恢复呼吸道通畅，应将患者头部后仰，清除口鼻内污物（D错，为本题正确答案）。溺水是一种常见的儿童意外伤害（A对），且溺水后可因口鼻吸入大量水分阻塞呼吸道而引起窒息反应（B对），也可因惊慌、骤然寒冷引起反射性喉头痉挛而导致窒息（C对）。在急救处理口对口人工呼吸时，应配合进行胸外心脏按压（E对）。